某病发病率水平超过该地一定历史条件下的流行水平，迅速蔓延跨省、国家、洲界
A. 散发
B. 暴发
C. 流行
D. 大流行
E. 大暴发

正确答案：D。大流行

解析：本题考查大流行的概念。大流行（D对ABCE错）是指某病发病率显著超过该病历年发病率水平，疾病蔓延迅速，涉及地区广，在短期内跨越省界、国界甚至洲界形成世界性流行。